关于牙半切术的手术方法叙述不正确的是
A. 伤口完全愈合后，进行牙体或牙列的修复
B. 将患牙从牙冠向根分叉部位分为近远中两部分，以多保留健侧牙体为好
C. 术前进行根管治疗，髓室内以银汞合金充填
D. 拔除患侧冠根，无需骨修整
E. 切口、翻瓣同截根术，如根分叉已完全暴露，也可不做翻瓣

正确答案：D。拔除患侧冠根，无需骨修整

解析：手术方法：①术前进行根管治疗，髓室内以银汞合金充填。②切口、翻瓣同截根术，如根分叉已完全暴露，也可不做翻瓣。③使用金刚砂钻或涡轮裂钻，将患牙从牙冠向根分叉部位分为近远中两部分，切割的位置可稍偏向患侧处，以多保留健侧的冠根。④拔除患侧冠根，刮净拔牙窝及原根分叉区的病变组织，必要时做骨修整。⑤修整保留侧的断面边缘，形成良好的牙体外形。⑥龈瓣复位缝合。⑦伤口完全愈合后，进行牙体或牙列的修复。掌握“根分叉病变”知识点。